胎儿身长增长最快是
A. 孕前2周
B. 孕0～12周
C. 孕13～27周
D. 孕28～42周
E. 孕＞42周

正确答案：C。孕13～27周